苦楝皮的功效
A. 行气
B. 利水
C. 疗癣
D. 截疟
E. 止咳

正确答案：C。疗癣

解析：苦楝皮是驱虫药，苦、寒，有毒；入肝、脾、胃经。可杀虫、疗癣（C对）。有较强的杀虫作用，可治蛔虫病、蛲虫病等多种肠道寄生虫病，为广谱驱虫中药；能清热燥湿，杀虫止痒，治疗疥癣瘙痒。